病人饥不欲食
A. 胃火亢盛
B. 胃强脾弱
C. 脾胃气虚
D. 湿邪困脾
E. 胃阴不足

正确答案：E。胃阴不足

解析：胃阴不足，虚热内生，胃中虚热扰动，则饥；但胃虚失于和降，故不欲食（E对）。胃火亢盛，受纳腐熟太过，则消谷善饥（A错）。胃强脾弱，一般是指胃的消化功能过强，出现消谷善饥而脾的功能减弱，不能运化水谷精微充养机体，在临床中常见到胃纳如常或食欲旺盛，而大便不化或溏薄泄泻（B错）。脾胃气虚，以胃脘痞闷，似胀非胀，食少纳呆，食后胃脘发堵，倦怠无力；舌质淡或胖，苔薄白为特征（C错）。湿邪困脾，常见脘腹痞满、体倦身重、大便溏泻等证（D错）。